空、回肠动脉的来源
A. 肠系膜下动脉
B. 腹腔干
C. 脾动脉
D. 肠系膜上动脉
E. 无

正确答案：D。肠系膜上动脉

解析：由肠系膜上动脉（D对）的左侧壁发出空肠动脉和回肠动脉，分布于空肠和回肠。